走行于桡神经沟内
A. 桡动脉
B. 腋动脉
C. 旋肱后动脉
D. 肱深动脉
E. 旋肱前动脉

正确答案：D。肱深动脉

解析：肱深动脉（D对）走行于桡神经沟内，发出分支营养肱二头肌和肱骨，其终支参与肘关节网的组成。